关于继发性肺结核病下列哪项正确
A. 病变在肺内无一定好发部位
B. 肺门淋巴结常有明显的结核病变
C. 不治疗多数能自然痊愈
D. 不易有空洞形成
E. 咯血是常见的死亡原因之一

正确答案：E。咯血是常见的死亡原因之一

解析：肺结核病可分为原发性和继发性两大类，继发性肺结核是指再次感染结核杆菌所引起的肺结核病，多见于成人。病变常起始于肺尖部（A错），严重时可形成空洞（D错），不能自然痊愈，需长期进行治疗（C错）。继发性肺结核病主要分为以下几种类型：局灶性肺结核、浸润性肺结核、慢性纤维空洞性肺结、干酪样肺炎和肺结核球，其中在慢性纤维空洞型肺结核中，如空洞壁的干酪样坏死侵蚀较大的血管，可引起大咯血，患者可因吸入大量血液而窒息死亡（E对）。肺门淋巴结常有明显的结核病变（B错）是原发性肺结核病的特点。